一成人烧伤面积60%，7小时后入院，经注射吗啡，头孢类抗菌素和生理盐水1000ml，仍有休克，应考虑为
A. 神经性休克
B. 感染性休克
C. 心源性休克
D. 低血容量性休克
E. 中毒性休克

正确答案：D。低血容量性休克

解析：假设该成人患者体重为50kg（成人体重均值），患者烧伤面积为60%，根据烧伤补液原则（P142-P143），第一个24小时补液总量为60×50×1.5＋2000=6500ml，其中胶体为60×50×0.5=1500ml，电解质液为60×50×1=3000ml，水分为2000ml，伤后前8小时内输入总量的一半即3250ml，而患者伤后7小时入院仅补液1000ml，远远达不到所需补液量，该患者补液后仍休克，应考虑为低血容量性休克（D对）。神经性休克（A错）多有手术麻醉史或神经调节器官遭到损害史，如腰脊髓麻醉、硬膜外麻醉等，其发生常极为迅速，具有很快的逆转倾向，不伴有持续而严重的组织灌流不足以及微血管损害。感染性休克（B错）和中毒性休克（E错）多发生在烧伤后3～10天，该患者处于伤后7小时，短时间内不会引起感染性休克和中毒性休克。心源性休克（C错）是指由于心脏功能极度减退，导致心输出量显著减少并引起严重的急性周围循环衰竭的一组综合征，该患者没有心脏病史，故不考虑心源性休克。